疱疹病毒感染的首选药是
A. 齐多夫定
B. 阿昔洛韦
C. 利巴韦林
D. 金刚烷胺
E. 阿糖腺苷

正确答案：B。阿昔洛韦